下列哪种情况处方权由其所在医疗机构予以取消
A. 被责令暂停执业
B. 考核不合格离岗培训期间
C. 不按照规定开具处方，造成严重后果的
D. 因开具处方牟取私利
E. 以上都正确

正确答案：E。以上都正确

解析：医师出现下列情形之一的，处方权由其所在医疗机构予以取消：①被责令暂停执业；②考核不合格离岗培训期间；③被注销、吊销执业证书；④不按照规定开具处方，造成严重后果的；⑤不按照规定使用药品，造成严重后果的；⑥因开具处方牟取私利。掌握“处方的开具、监督管理及法律责任”知识点。